真核细胞染色质的基本组成单位是核小体。在核小体中
A. rRNA与组蛋白八聚体相结合
B. rRNA与蛋白因子结合成核糖体
C. 组蛋白H1、H2、H3和H4各两分子形成八聚体
D. 组蛋白H2A、H2B、H3和H4各两分子形成八聚体
E. 非组蛋白H2A、H2B、H3和H4各两分子形成八聚体

正确答案：D。组蛋白H2A、H2B、H3和H4各两分子形成八聚体